更能反映龈炎活动情况的是
A. 菌斑指数
B. 牙龈指数
C. 龈沟出血指数
D. 简化口腔卫生指数
E. 社区牙周指数

正确答案：C。龈沟出血指数

解析：本题考查评价牙周健康的指数。更能反映龈炎活动情况的是龈沟出血指数（C对）。根据龈沟出血情况对牙龈进行评价更能反映龈炎的活动状况。菌斑指数（A错）：用于测量口腔中菌斑的情况。牙龈指数（B错）：该指数不考虑有无牙周袋及牙周袋深度，只观察牙龈情况，检查牙龈颜色和质的改变以及出血倾向。简化口腔卫生指数（D错）：包括简化软垢指数和简化牙石指数。简化口腔卫生指数可以用于个人，但主要用于人群口腔卫生状况评价。社区牙周指数（E错）：采用指数牙进行检查，检查内容包括牙龈出血、牙石和牙周袋深度，所检查牙齿只记录最高记分。